女孩，8岁。浮肿，尿少3天入院，神清，眼睑浮肿明显，双下肢非凹陷性水肿，血压140/90mmHg，心肺无异常。假若该患儿出现剧烈头痛、呕吐、抽搐，首先应考虑出现
A. 中毒性脑病
B. 颅内出血
C. 化脓性脑膜炎
D. 低钠性脑水肿
E. 高血压脑病

正确答案：E。高血压脑病

解析：根据该患儿眼睑浮肿明显，双下肢非凹陷性水肿，尿少，初步判定为急性肾小球肾炎，严重表现有高血压脑病，年长儿会主诉剧烈头痛、呕吐、复视或一过性失明，严重者突然出现惊厥、昏迷（E对）。中毒性脑病（A错）和颅内出血（B错）虽然有呕吐和抽搐症状，一般不出现眼睑浮肿、双下肢指凹性水肿症状。化脓性脑膜炎多见于5岁以下儿童，也无全身性水肿（C错）。低钠性脑水肿临床表现为头晕、头痛，定向力丧失，视力模糊，也无下肢水肿（D错）。